女婴，9个月，发热、咳嗽3天，憋喘半天，查体：T37.8℃，P180次/分，R60次/分，精神烦躁，鼻翼扇动，三凹征阳性，双肺布满中小水泡音，心率齐，心音低钝，未闻杂音，肝肋下3.5cm，前囟平，最可能的诊断是
A. 支气管哮喘
B. 支气管异物
C. 毛细支气管炎
D. 支气管肺炎合并中毒性脑病
E. 支气管肺炎合并心力衰竭

正确答案：E。支气管肺炎合并心力衰竭

解析：患儿发热、咳嗽（提示上呼吸道感染），后出现憋喘，精神烦躁，呼吸明显增快，并可见鼻翼扇动和三凹征阳性，肺部可闻及中细湿啰音，据患儿临床表现，体征考虑诊断为支气管肺炎。又P180次/分（正常120～140次/分），心音低钝（系心肌炎心肌收缩力下降），肝肋下3.5cm（正常不可触及），提示右心衰，因此最可能的诊断是支气管肺炎合并心力衰竭（E对）。支气管肺炎合并中毒性脑病（D错）会有前囟隆起，嗜睡，呼吸心跳解离（有心跳，无呼吸）等表现。支气管哮喘（A错）：患儿具有过敏体质，可无明显喘息发作，主要表现为待续性咳嗽。胸部X线检查示肺纹理增多排列紊乱和肺气肿易与本病混淆。肺功能检查及支气管激发和支气管舒张试验有助于鉴别。气管异物（B错）患儿有异物吸入史，表现为突然出现呛咳，可致肺不张和肺气肿。毛细支气管炎（C错）多见于2～6月婴儿，系毛细支气管狭窄堵塞而致的呼气性呼吸困难，可有发热，呼吸浅快，三凹征及肝脾肋下触及（肺过度充气向下推所致），易与本病混淆，但毛细支气管炎主要体征为肺部哮鸣音明显，支气管肺炎多为局部湿啰音。